牙槽骨出现活跃的破骨细胞性骨陷窝，是以下哪项病理表现
A. 牙周炎静止期
B. 牙周炎活动期
C. 牙周变性
D. 牙周创伤
E. 牙周萎缩

正确答案：B。牙周炎活动期

解析：本题考查活动期牙周炎的病理变化。牙槽骨出现活跃的破骨细胞性骨陷窝，是牙周炎活动期（B对）的病理表现。牙周炎活动期的病理变化包括牙槽骨出现活跃的破骨细胞性骨陷窝，牙槽嵴顶及固有牙槽骨可见多数吸收、破坏这一特点。掌握“牙周炎”知识点。